治疗精血亏虚，头晕眼花，腰酸脚软，久疟，痈疽瘰疬，肠燥便秘，应选用的药物是
A. 熟地黄
B. 白芍
C. 何首乌
D. 当归
E. 鹿茸

正确答案：C。何首乌

解析：制何首乌功善补肝肾，益精血，乌须发，强筋骨，兼能收敛，不寒，不燥，不腻，为滋补良药，能治疗精血亏虚，腰膝酸软，头晕眼花；生何首乌功善解毒消痈散结、截疟、润肠通便，能治疗痈疽瘰疬，久疟，肠燥便秘（C对）。熟地黄（A错）用于心悸怔忡，月经不调，腰膝酸软，骨蒸潮热，盗汗遗精，眩晕耳鸣，须发早白。白芍（B错）用于血虚萎黄，月经不调，自汗盗汗，胁痛，腹痛，四肢拘挛疼痛，头痛眩晕。当归（D错）用于血虚萎黄，眩晕心悸，血虚、血瘀之月经不调，经闭痛经，虚寒腹痛，风湿痹痛，痈疽疮疡，血虚肠燥便秘。鹿茸（E错）用于肾阳不足，阳痿遗精，宫寒不孕，畏寒，眩晕，耳鸣耳聋，肾虚腰脊冷痛，筋骨痿软，冲任虚寒，崩漏带下。